有关医学道德教育的过程，不正确的是
A. 提高医学道德认识
B. 陶冶医学道德情感
C. 加强专业实践能力
D. 锻炼医学道德意志
E. 养成良好的医学道德行为和习惯

正确答案：C。加强专业实践能力

解析：医学道德教育的过程：提高医学道德认识，陶冶医学道德情感，锻炼医学道德意志，树立医学道德信念，养成良好的医学道德行为和习惯。掌握“医学道德教育”知识点。